某研究员在其发表的一篇论文中使用了他人的部分图表及数据，但未加注明，后被杂志社撤稿。该研究员的做法违背的医学科研伦理要求是
A. 知情同意
B. 敢于怀疑
C. 知识公开
D. 诚实严谨
E. 团队协作

正确答案：D。诚实严谨

解析：医学科研人员的道德规范：（－）尊重科学，严谨治学（二）动机纯正，勇于创新（三）谦虚谨慎，团结协作（E错）。研究员在发表的论文中使用了他人的部分图表及数据，但未加注明。该研究员的做法违背的医学科研伦理要求是诚实严谨（D对）。